居室内的自然照度至少需要多少才能基本满足视觉功能的生理需要
A. 55lx
B. 60lx
C. 65lx
D. 70lx
E. 75lx

正确答案：E。75lx

解析：本题考查居室内的自然照度。居室内的自然照度至少需要75lx（E对ABCD错）才能基本满足视觉功能的生理需要。